属于氯化消毒副产物的是
A. THM、HAA、MX
B. MC、MX、PCB
C. THM、HAAs、PCB
D. HAA、MC、MX
E. HAA、MX、PCB

正确答案：A。THM、HAA、MX

解析：本题考查氯化消毒副产物。氯化消毒副产物系指在氯化消毒过程中的氯与水中有机物反应所产生的卤代烃类化合物。属于氯化消毒副产物的是三卤甲烷（THM）、卤代乙酸（HAA）、3-氯-4-二氯甲基-5 -羟基-2（5氢）呋喃酮（MX）（A对BCDE错）。